用盐酸副玫瑰苯胺比色法测定大气中SO₂时，使空白管颜色加深的原因可能是
A. 甲醛浓度过高
B. 氨基磺酸铵用量太少
C. 盐酸副玫瑰苯胺中盐酸用量过少
D. 四氯汞钠溶液用量过少
E. 以上都不是

正确答案：C。盐酸副玫瑰苯胺中盐酸用量过少

解析：本题考查盐酸副玫瑰苯胺比色法。用盐酸副玫瑰苯胺比色法测定大气中SO₂时，使空白管颜色加深的原因可能是盐酸副玫瑰苯胺中盐酸用量过少（C对ABDE错）。